确定牙槽骨吸收的标准是
A. 牙齿松动Ⅱ°以上为有骨吸收
B. 牙周袋深度大于4mm的有骨吸收
C. 牙槽嵴顶到釉牙骨质界的距离超过2mm有骨吸收
D. X线片示牙槽骨与牙根面之间形成角形骨缺损
E. 以上均不对

正确答案：C。牙槽嵴顶到釉牙骨质界的距离超过2mm有骨吸收

解析：本题考查确定牙槽骨吸收的标准。正常情况下，牙槽嵴顶到釉牙骨质界的距离为1～1.5mm，不超过2mm，当超过2mm时，则可认为有牙槽骨吸收（C对）。